十二经脉的循行走向错误的是
A. 手三阴经从头走手
B. 足三阳经从头走足
C. 足三阴经从足走腹（胸）
D. 手三阳经从手走头
E. 以上都不对

正确答案：A。手三阴经从头走手

解析：十二经脉的循行走向总的规律是手三阴经从胸走手第十版针灸学（A错，为本题正确答案），手三阳经从手走头（D对），足三阳经从头走足（B对），足三阴经从足走腹胸（C对）。